使用烟草一定时间后，就可以成瘾，它是一种慢性高复发性疾病，其本质是
A. 药物依赖
B. 精神依赖
C. 尼古丁依赖
D. 烟焦油依赖
E. 苯依赖

正确答案：C。尼古丁依赖

解析：使用烟草一定时间后，就可以成瘾，即所谓的烟草依赖疾病。它是一种慢性高复发性疾病，其本质是尼古丁依赖。掌握“干预基本模式及烟草行为干预”知识点。